关于监测体系说法错误的是
A. 可以是以人群为基础的监测
B. 可以是以医院为基础的监测
C. 可以是以个人为基础的监测
D. 可以是对某个公共卫生问题的监测
E. 可以是对某种疾病的监测

正确答案：C。可以是以个人为基础的监测